属于口服片剂的有
A. 咀嚼片
B. 舌下片
C. 分散片
D. 泡腾片
E. 口腔贴片

正确答案：A、C、D。咀嚼片；分散片；泡腾片

解析：本题考查的是口服片剂的分类。属于口服片剂的有咀嚼片（A对）、分散片（C对）与泡腾片（D对）。按给药途径及其作用，片剂可分为以下主要类型：（1）口服片：系指经口服，在胃肠道崩解、吸收而发挥局部或全身治疗作用的片剂。应用最为广泛。①口服普通片；②咀嚼片；③分散片；④泡腾片；⑤缓释片；⑥控释片；⑦肠溶片；⑧口崩片。（2）口腔用片：①含片；②舌下片（B错）；③口腔贴片（E错）。（3）外用片：常用的是阴道片与阴道泡腾片，系指至于阴道内应用的片剂。（4）其他：可溶片，系指临用前能溶解于水的非包衣片或薄膜包衣片剂。可供口服、外用、含漱等。